慢性氟中毒的临床表现是
A. 腹泻
B. 昏迷
C. 恶心
D. 氟骨症
E. 肠道出血

正确答案：D。氟骨症

解析：慢性氟中毒：机体长期摄入过量的氟可导致慢性氟中毒。根据氟来源的不同，慢性氟中毒可分为地方性氟中毒和工业氟中毒。慢性氟中毒的主要临床表现是氟牙症、氟骨症。氟骨症主要表现为骨质硬化和骨旁软组织骨化。掌握“氟毒性及氟牙症”知识点。